一患者使用某化妆品后5～7天，再次使用时局部皮肤出现红肿、水泡、大疱，病变皮肤边界不清，患处有瘙痒和灼热感。此病情应诊断为
A. 刺激性接触性皮炎
B. 变应性接触性皮炎
C. 光敏性皮炎
D. 光毒性皮炎
E. 急性皮炎

正确答案：B。变应性接触性皮炎